不完全康复时
A. 损伤性变化得到控制
B. 损伤性变化完全消失
C. 两者均有
D. 两者均无
E. 无

正确答案：A。损伤性变化得到控制

解析：不完全康复是指疾病所致的损伤得到控制（A对），主要症状消失，机体通过代偿机制维持相对正常的生命活动。